不属于原发性肾病综合征常见的病理类型是
A. 微小病变型肾病
B. 系膜增生性肾炎
C. 毛细血管内增生性肾炎
D. 膜性肾病
E. 局灶性节段性肾小球硬化

正确答案：C。毛细血管内增生性肾炎

解析：原发性肾病综合征常见的病理类型是微小病变型肾病（A对）、系膜增生性肾小球肾炎（B对）、局灶节段性肾小球硬化（E对）、系膜毛细血管性肾小球肾炎、膜性肾病（D对）。毛细血管内增生性肾炎（C错，为正确答案）是急性肾炎的病理类型。